来访者，男，18岁，大学生，求助的问题是，多年来不能感知自己内心的感受，更不知如何向其他人，包括自己的家人讲述自己内心的感受，从而来寻求帮助。对于这样的来访者，心理治疗师首选的方法为
A. 人本主义
B. 精神分析
C. 生物反馈
D. 厌恶治疗
E. 催眠治疗

正确答案：A。人本主义